男性尿道最狭窄的部位是
A. 前列腺部
B. 膜部
C. 尿道内口
D. 尿道外口
E. 尿道球部

正确答案：D。尿道外口

解析：男性尿道有三个狭窄、三个膨大和两个弯曲。三个狭窄分别是尿道内口、尿道膜部和尿道外口；其中外口最窄（D对），呈矢状裂隙。